关于固定桥桥体龈端的描述不正确的是
A. 尽量减小与黏膜的接触面积
B. 紧贴黏膜，稍微加压
C. 高度抛光
D. 唇颊侧颈缘线与邻牙一致
E. 扩大舌侧邻间隙

正确答案：B。紧贴黏膜，稍微加压

解析：固定桥桥体有便于清洁的外形和良好的光洁度，符合口腔卫生需求。龈面大小适宜，接触式桥体应与黏膜密合而不压迫黏膜。桥体的颈缘线应该与邻牙相协调，才能达到良好的美观效果。后牙舌腭侧邻间隙应该扩大，以便食物溢出和清洁。掌握“固定桥的设计”知识点。